牙龈纤维瘤病最早发病于
A. 乳牙萌出前
B. 乳牙萌出后
C. 乳牙脱落后
D. 恒牙萌出后
E. 18岁以后

正确答案：B。乳牙萌出后

解析：牙龈纤维瘤病可在幼儿时就发病，最早可发生在乳牙萌出后，一般开始于恒牙萌出之后。掌握“牙龈纤维瘤病”知识点。